以下方法检查的杂质是，在盐酸溶液中，与硫氰酸铵试液反应，生成红色产物
A. 氯化物
B. 硫酸盐
C. 铁盐
D. 砷盐
E. 澄清度

正确答案：C。铁盐